一岁女婴，反复发热、恶心5天，喷射性呕吐一次，克氏征阳性，脑脊液检查：WBC:600×10⁹/L，N:0.8，L:0.2，蛋白2g/l，糖1.8mmol/l，氯化物16mmol/l，考虑诊断为哪种疾病
A. 化脓性脑膜炎
B. 结核性脑膜炎
C. 中毒性脑病
D. 隐球菌性脑炎
E. 病毒性脑炎

正确答案：A。化脓性脑膜炎

解析：一岁女婴，反复发热、恶心5天，喷射性呕吐一次，克氏征阳性（化脓性脑膜炎的表现），脑脊液检查：WBC:600*10⁹/L，N:0.8，L:0.2，蛋白2g/l，糖1.8mmol/l，氯化物16mmol/l（化脓性脑膜炎的脑脊液检查结果），结合患者的表现和辅助检查，考虑诊断为化脓性脑膜炎（A对）。（P291） 结核性脑膜炎 脑脊液压力增高可达400mmH₂0或以上，外观无色透明或微黄，静置后可有薄膜形成；淋巴细胞数显著增多，常为（50～500）×10⁶ / L；蛋白质增高，通常为1～2g/L,糖及氯化物下降，典型脑脊液改变可高度提提示诊断（B错）。新型隐球菌脑膜炎的脑脊液检查：压力常增高，淋巴细胞数轻度、中度增多，一般为（10～500）×10⁶/L,以淋巴细胞为主，蛋白质含量增高，糖含量降低，脑脊液离心沉淀后涂片做墨汁染色，检出隐球菌可确定诊断（D错）。“病毒性脑膜炎脑脊液压力正常或增高，白细胞数正常或增高，可达（10～1000）×10⁶/L,早期以多形核细胞为主，8～48小时后以淋巴细胞为主。蛋白质可轻度增高，糖和氯化物含量正常（E错）。以上四种疾病的脑脊液检查结果与化脓性脑膜炎的脑脊液检查结果不一样。